关于散剂的叙述，正确的有
A. 剂量在0.01g以下的药物应配成1：100或1：1000的倍散
B. 刺激性大、腐蚀性强的药物不宜制成散剂
C. 眼用散应通过九号筛，且应无菌
D. 倍散制备时，混合应采用等量递增法
E. 含毒性药的内服散剂应单剂量包装

正确答案：A、B、C、D、E。剂量在0.01g以下的药物应配成1：100或1：1000的倍散；刺激性大、腐蚀性强的药物不宜制成散剂；眼用散应通过九号筛，且应无菌；倍散制备时，混合应采用等量递增法；含毒性药的内服散剂应单剂量包装

解析：本题考查散剂的制备。关于散剂的叙述，正确的有剂量在0.01g以下的药物应配成1：100或1：1000的倍散（A对）；刺激性大、腐蚀性强的药物不宜制成散剂（B对）；眼用散应通过九号筛，且应无菌（C对）；倍散制备时，混合应采用等量递增法（D对）；含毒性药的内服散剂应单剂量包装（E对）。含毒性药物散剂制备：剂量在0.01～0.1g时，可制成10碚散（药物与稀释剂比例为1：9）；剂量在0.01g以下时，可制成100倍散或1000倍散。散剂的特点：①因药物粉末的比表面积较大，易分散，吸收、起效迅速。②制备简便。③外用对疮面有一定的机械性保护作用，多用于口腔科、耳鼻喉科、伤科和外科等，也适于小儿给药。但散剂易吸潮、药物成分易散失、氧化，所以易吸湿或易氧化变质的药物、刺激性大的药物、含挥发性成分多且剂量大的药物不宜制成散剂。散剂质量要求：供制备散剂的原料药均应粉碎。除另有规定外，内服散剂应为细粉；儿科及局部用散剂应为最细粉；眼用散剂应为极细粉，且应无菌。按照《中国药典》要求，细粉系指能全部通过五号筛，并含能够通过六号筛不少于95%的粉末；最细粉系指能全部通过六号筛，并含能够通过七号筛不少于95%的粉末；极细粉系指能全部通过八号筛，并含能够通过九号筛不少于95%的粉末。散剂制法：1.粉碎与过筛。2.混合。等量递增法亦称“配研法”，遵循药物粉末等比、等量容易混合均匀的原则，将量小的组分与等量的其他组分混合，均匀后再加人与混合物等量的组分混合，如此倍量增加，始终保持等量，直至将其他组分完全混入为止。该法混合效果好，省时，适用于含毒性药物、贵重药、剂量小药物的散剂。3.分剂量：分剂量是将混合均匀的散剂按剂量要求进行分装的过程。多剂量包装的散剂应附分剂量的用具，含毒性药物的内服散剂应单剂量包装。